孟某，女，30岁，平素形体消瘦，性情急躁，现胁痛口苦，纳呆泛恶，目黄尿赤，舌苔黄而腻，脉弦滑，前医用茵陈蒿汤治疗未效，此时治疗的首选方是
A. 柴胡疏肝散
B. 血府逐瘀汤
C. 滋水清肝饮
D. 丹栀逍遥丸
E. 龙胆泻肝汤

正确答案：E。龙胆泻肝汤

解析：患者平素形体消瘦，性情急躁，湿热瘀结于肝胆，肝络失和，肝失疏泄，突病胁痛口苦；湿热中阻，升降失常故见纳呆泛恶；湿热熏蒸，胆汁不循常道而外溢故见目黄、身黄，小便黄赤；舌苔黄而腻，脉弦滑，为肝胆实火上炎的表现，治疗需清利肝胆实火，方药选用龙胆泻肝汤加减（E对）。柴胡疏肝散（A错）可以疏肝理气，治疗肝郁气滞证。血府逐瘀汤（B错）可以活血化瘀，理气止痛，用于治疗瘀血腹痛。滋水清肝饮（C错）可以滋阴养血，清热疏肝，治疗阴虚肝郁，胁肋胀痛，胃脘疼痛。丹栀逍遥丸（D错）可以健脾益气，疏肝清热，治疗脾虚肝郁化火证。